盐酸吗啡的检查项目有
A. 其他金鸡纳碱
B. 阿扑吗啡
C. 罂栗酸
D. 莨菪碱
E. 其他生物碱

正确答案：B、C、E。阿扑吗啡；罂栗酸；其他生物碱